男孩，10岁。因高度水肿及大量蛋白尿，予泼尼松60mg/d治疗10周，病情未缓解来诊。查体：T36.5℃，P80次/分，R18次/分，颜面明显水肿，面色苍白，肺部未闻及啰音，心（-），腹部较膨隆，肝脾触及不清，四肢明显水肿，实验室检查：蛋白尿（+++），尿沉渣镜检RBC50/HP，肾功能正常。对其激素疗效判断正确的是
A. 激素耐药
B. 激素敏感
C. 肾病复发
D. 激素依赖
E. 肾病频复发

正确答案：A。激素耐药

解析：该患儿予泼尼松60mg/d治疗10周，病情未缓解，符合激素耐药型肾病（以泼尼松足量治疗＞8周尿蛋白仍呈阳性）的诊断（A对）。激素敏感型肾病（B错）是指以泼尼松足量治疗≤8周尿蛋白转阴的肾病综合征。肾病复发（C错）是指连续3天，尿蛋白由阴性转为（+++）或（++++），或24小时尿蛋白定量≥50mg/kg或尿蛋白/肌酐（mg/mg）≥2.0。激素依赖型肾病（D错）是指对激素敏感，但连续2次减量或停药2周内复发的肾病综合征。肾病频复发（E错）是指肾病病程中半年内复发≥2次，或1年内复发≥3次。